股疝最常用的手术方法是
A. Ferguson法
B. Halsted法
C. Bassini法
D. Shoulice法
E. McVay法

正确答案：E。McVay法

解析：股疝容易嵌顿，一旦嵌顿可迅速发展为绞窄性疝。因此，股疝诊断确定后，应及时手术治疗。股疝最常用的手术方法为McVay修补法（E对）。McVay修补法能够堵住股环而用于修补股疝，还可以加强腹股沟管后壁而用于修补腹股沟疝。Ferguson法（A错）、Halsted法（B错）、Bassini法（C错）、Shouldice法（D错）均为腹股沟疝常用的手术方法，其中Ferguson法用于加强腹股沟管前壁，Halsted法、Bassini法、Shouldice法用于加强腹股沟管后壁。